下列有关mRNA结构的叙述，正确的是
A. 3＇端有甲基化鸟嘌呤尾结构
B. 链的二级结构为单链卷曲和单链螺旋
C. 三个相连核苷酸组成一个反密码子
D. 5＇端有多聚腺苷酸帽子结构
E. 链的局部可形成双链结构

正确答案：E。链的局部可形成双链结构

解析：本题考查mRNA的结构。有关mRNA结构的叙述，正确的是链的局部可形成双链结构（E对），真核生物mRNA的3＇-端有多聚腺苷酸尾（A错）；三个相连核苷酸组成一个密码子（C错）；真核生物mRNA的5＇-端有特殊帽结构（D错）。